男，67岁吸烟者。家属发现患者呼之不应半小时急送医院。有COPD病史30余年。查体：BP150/50mmHg，浅昏迷状，球结膜水肿。双肺可闻及干湿啰音，A₂＜P₂。下肢水肿。为明确诊断首选的检查是
A. 动脉血气分析
B. 胸部X线片
C. 心脏超声波
D. 动态心电图
E. 肺功能

正确答案：A。动脉血气分析

解析：患者为老年男性，有COPD的病史（为发生呼吸衰竭的常见危险因素），现浅昏迷状，球结膜水肿，P₂＞A₂，根据其临床表现和体征，考虑发生了Ⅱ型呼吸衰竭+肺性脑病。明确诊断呼吸衰竭首选动脉血气分析（A对），可测定体内PaO₂和PaCO₂等指标，有助于明确诊断。胸部X线片（B错）主要对胸部占位性病变、肺结核、肺炎等的诊断有意义，对呼吸衰竭的诊断价值不大。心脏超声波（C错）主要用于诊断心脏瓣膜病及心包疾病等。动态心电图（D错）主要用于心血管系统的诊断，特别是对心律失常的诊断有意义。肺功能（E错）主要用于鉴别阻塞性通气功能障碍和限制性通气功能障碍。